子处又称
A. 血海
B. 血室
C. 胞络
D. 胞脉
E. 天癸

正确答案：B。血室

解析：子处是子宫的别名，子宫又称为血室，故子处又称为血室（B对）。血海为冲脉的别称，冲脉总领诸经气血的要冲，并能调节十二经脉气血，故称为血海（A错）。附着于子宫的脉络称胞脉、胞络（C、D错）。天癸，是肾精肾气充盛到一定程度时体内出现的具有促进人体生长、发育和生殖的一种精微物质（E错）。